小儿腹泻等渗性脱水，血钠值应是
A. 90～110mmol/L
B. 110～130mmo/L
C. 130～150mmo/L
D. 150～160mmol/L
E. 160～170mmoL/L

正确答案：C。130～150mmo/L